铁的吸收部位是在
A. 十二指肠及空肠上段
B. 回肠中段
C. 回肠末段
D. 胃窦
E. 胃底

正确答案：A。十二指肠及空肠上段

解析：铁主要在小肠上部（十二指肠及空肠上段）吸收（A对）。教材中未明确说明回肠中段（B错）吸收的物质，但其不是铁吸收的部位。回肠末段（C错）可吸收胆盐和维生素B₁₂。胃（P194）（DE错）主要起到储存和初步消化食物的功能，仅能吸收乙醇和少量水。